男，27岁。近1月来感双眼酸胀不适，1周前出现上肢酸软乏力，在傍晚或者运动后加重，清晨减轻。查体：左侧上肢肌力3级。小便正常，大便障碍。考虑该患者为
A. 周期性瘫痪
B. 重症肌无力
C. 吉兰巴雷综合征
D. 周围神经炎
E. 甲亢

正确答案：B。重症肌无力

解析：男，27岁。近1月来感双眼酸胀不适（眼部肌群开始），1周前出现上肢酸软乏力，在傍晚或者运动后加重，清晨减轻（晨轻暮重是重症肌无力的典型表现）。查体：左侧上肢肌力3级（肌力下降）。小便正常，大便障碍。考虑该患者为重症肌无力（B对）。周期性瘫痪（A错）指反复发作性的骨骼肌弛缓性瘫痪为主要表现的一组肌病。发作时大多伴有血清钾的异常改变。吉兰巴雷综合征（B错）呈四肢弛缓性瘫痪，远端重于近端，可有周围性感觉障碍和脑神经损害，脑脊液蛋白－细胞分离现象。周围神经炎（D错）主要表现为肢体远端对称性感觉、运动和植物神经功能障碍。甲亢（E错）导致的周期性瘫痪，发作时常伴血钾降低。